测定糖链结构应解决的主要问题有
A. 糖链中非糖部分的结构
B. 糖之间的连接顺序
C. 糖之间的连接位置
D. 单糖的组成
E. 糖之间苷键的构型

正确答案：B、C、D、E。糖之间的连接顺序；糖之间的连接位置；单糖的组成；糖之间苷键的构型